积滞的病机是
A. 脾胃虚寒
B. 湿热中阻
C. 胃失和降
D. 食滞不化
E. 胃阴亏虚

正确答案：D。食滞不化

解析：引起积滞的主要原因为乳食不节，伤及脾胃，致脾胃运化功能失调，或脾胃虚弱，腐熟运化不及，乳食停滞不化。其病位在脾胃，基本病理机制为乳食停聚中脘，积而不化，气滞不行（D对）。